可出现甲状腺肿大伴震颤及血管杂音的是
A. 单纯性甲状腺肿
B. 甲状腺功能亢进症
C. 甲状腺腺瘤
D. 甲状腺癌
E. 慢性淋巴细胞性甲状腺炎

正确答案：B。甲状腺功能亢进症

解析：甲状腺肿大伴震颤及血管杂音是甲状腺功能亢进症的临床表现（B对）。单纯性甲状腺肿是以缺碘为主的代偿性甲状腺肿大，青年女性多见，一般不伴有甲状腺功能异常（A错）。甲状腺腺瘤患者多无症状，体检时可发现颈部肿物（C错）。甲状腺癌早期临床表现不明显，多无自觉症状，颈部肿块可逐渐增大，随吞咽上下活动，并可侵犯气管而固定，肿块易较早产生压迫症状，如伴有声音嘶哑，呼吸不畅，吞咽困难等（D错）。慢性淋巴细胞性甲状腺炎患者全身乏力，甲状腺多为双侧对称性、弥漫性肿大，甲状腺往往随病程发展而逐渐增大，但很少压迫颈部出现呼吸和吞咽困难（E错）。